下列哪个药物属于胆碱酯酶复活药
A. 新斯的明
B. 碘解磷定
C. 毒扁豆碱
D. 安贝氯铵
E. 阿托品

正确答案：B。碘解磷定

解析：胆碱酯酶复活剂主要用于有机磷酸酯类中毒的解救，是一类能使失活的胆碱酯酶恢复活性的药物，常用的有碘解磷定和氯解磷定，他们都是肟类化合物。掌握“难逆性抗胆碱酯酶药及胆碱酯酶复活药”知识点。